患者入院诊断为肺部感染，病原学检查为耐甲氧西林金黄色葡萄球菌。使用万古霉素1000mg/次，静脉滴注，每12h应用1次。为使血栓性静脉炎的发生风险最小化，临床需要将万古霉素溶液的浓度稀释为4mg/ml。在配置时，需要5%葡萄糖注射液的容量是
A. 250ml
B. 48ml
C. 100ml
D. 480ml
E. 800ml

正确答案：A。250ml

解析：本题考查百分浓度的计算。重量比体积百分浓度系指100ml溶液中所含溶质的克数，以符号“%（g/ml）”表示。重量比体积百分浓度[%（g/ml）]=溶质重量（g）/溶液体积（ml）×100%。将题目中已知条件溶质重量1000mg，百分浓度4mg/ml代入公式得到：4mg/ml=1000mg/V  V=1000mg/4（mg/ml）=250ml（A对）。